主要见于急性感染性心内膜炎的体征是
A. Janeway损害
B. 瘀点
C. 脾大
D. Roth斑
E. Osler结节

正确答案：A。Janeway损害

解析：Janeway损害（A对）为手掌和足底处直径1～4mm无痛性出血红斑，主要见于急性感染性心内膜炎。瘀点（B错）、脾大（C错）、Roth斑（D错）和Osler结节（E错）主要见于亚急性感染性心内膜炎。